患者神倦，肢厥，耳聋，五心烦热，心中憺憺大动，手指蠕动，舌干绛而萎，脉虚，其临床意义是
A. 肝肾阴虚证
B. 肾精耗损正
C. 肾阴虚证
D. 血虚动风证
E. 虚风内动证

正确答案：E。虚风内动证

解析：虚风内动证，肝肾阴虚，虚热内生，则无心烦热；心中憺憺大动亦系阴虚水亏，虚风内扰所致；肾精肝血耗损，筋脉失养，则手指蠕动甚或瘛疭；舌干绛而萎，脉虚，均为肝肾亏虚之征（E对）。肝肾阴虚证表现为腰酸胁痛、两目干涩、眩晕、耳鸣、遗精及阴虚症状（A错）。肾精耗损证表现为生长发育迟缓、生育机能低下、成人早衰等（B错）。肾阴虚证表现为腰酸而痛、遗精、经少、头晕耳鸣及阴虚症状（C错）。血虚动风证表现为手足颤动、肢体麻木及血虚症状（D错）。